当一氧化碳和氮氧化物共存时，两者毒性均增加，这种情况称为毒物的
A. 相加作用
B. 相乘作用
C. 拮抗作用
D. 独立作用
E. 竞争作用

正确答案：B。相乘作用

解析：本题考查毒物的相乘作用。当一氧化碳和氮氧化物共存时，两者毒性均增加，这种情况称为毒物的相乘作用（B对ACDE错）。